患者，男，64岁，夜间突发偏瘫、失语、头痛、恶心、呕吐，急诊入院。经影像学检查，诊断为缺血性脑卒中，距发病已7小时，可采用的治疗方案有
A. 注射用阿替普酶50mg静脉滴注St.
B. 阿司匹林肠溶片100mg嚼服St.
C. 依诺肝素钠注射液4000U皮下注射St.
D. 甘露醇注射液250ml快速静滴q6h
E. 阿司匹林肠溶片300mg嚼服St.

正确答案：C、D、E。依诺肝素钠注射液4000U皮下注射St.；甘露醇注射液250ml快速静滴q6h；阿司匹林肠溶片300mg嚼服St.

解析：本题考查缺血性脑卒中。可采用的治疗方案有：依诺肝素钠注射液4000U皮下注射St.（C对）；甘露醇注射液250ml快速静滴q6h（D对）；阿司匹林肠溶片300mg嚼服St.（E对）。题干中患者距发病已7小时，已经过了溶栓治疗的最佳3小时，需先积极抗脑水肿降颅压，防止脑疝形成。抗凝治疗常用普通肝素和低分子肝素。对于不符合溶栓适应证且无抗血小板治疗禁忌症的急性脑梗死患者在发病后应尽早给予阿司匹林。注射用阿替普酶（A错）和阿司匹林肠溶片（B错）的用药剂量不正确。注射用阿替普酶需用注射用水溶解为1mg/ml或2mg/ml的浓度；而阿司匹林肠溶片剂量为300mg嚼服St.才对。